牙冠修复体邻面与邻牙紧密接触的意义不包括
A. 防止食物嵌塞
B. 维持牙位、牙弓形态的稳定
C. 保持与邻牙相互支持，分散（牙合）力
D. 有利于每个牙在咀嚼时保持各自的生理运动
E. 可增加咀嚼力

正确答案：E。可增加咀嚼力

解析：本题考查修复体邻面与邻牙紧密接触的意义。增加咀嚼力（E错，为本题的正确答案）主要靠增加参与咀嚼的肌肉所发挥的肌力，但与牙冠修复体邻面和邻牙是否紧密接触无关，咀嚼效率除与咀嚼力的大小有关，还与咬合关系有关，如咬合接触面积较大时可增加咀嚼效率。牙冠修复体邻面与邻牙紧密接触可防止食物嵌塞（A对）。可维持牙位、牙弓形态的稳定（B对）。还可起到使邻牙相互支持，分散（牙合）力（C对）的作用。在牙齿咀嚼时，其生理运动有利于牙冠修复体邻面与邻牙之间邻接面的形成，同时，牙冠修复体邻面与邻牙的紧密接触也有利于每个牙在咀嚼时保持各自的生理运动（D对）。